申请个体行医的，须经执业医师注册后在医疗、预防、保健机构中执业满
A. 1年
B. 2年
C. 3年
D. 4年
E. 5年

正确答案：E。5年

解析：申请个体行医的执业医师，须经注册后在医疗、预防、保健机构中执业满5年，并按照国家有关规定办理审批手续；未经批准，不得行医。县级以上地方人民政府卫生行政部门对个体行医的医师，应当按照国务院卫生行政部门的规定，经常监督检查，发现有《执业医师法》规定的注销注册情形的，应当及时注销注册，收回医师执业证书。掌握“执医概述及考试和注册”知识点。